《中国药典》2010年版一部收藏的石斛品种有
A. 鼓槌石斛
B. 细叶石仙桃
C. 流苏金石斛
D. 流苏石斛
E. 金钗石斛

正确答案：A、D、E。鼓槌石斛；流苏石斛；金钗石斛

解析：本题考查的是石斛的来源。《中国药典》2010年版一部收藏的石斛品种有鼓槌石斛（A对）、流苏石斛（D对）、金钗石斛（E对）。石斛：【来源】为兰科植物金钗石斛、霍山石斛、鼓槌石斛或流苏石斛的栽培品及其同属植物近似种的新鲜或干燥茎。